患者，女，28岁，已婚。经前小腹疼痛拒按，有灼热感，平素少腹时有隐痛，经来时疼痛加剧，低热，经色暗红，质黏，带下黄稠，溲黄，舌红苔黄腻，脉弦数。其治法是
A. 理气活血，化瘀止痛
B. 清热除湿，化瘀止痛
C. 益气补血，化瘀止痛
D. 养血柔肝，理气止痛
E. 调和营卫，化瘀止痛

正确答案：B。清热除湿，化瘀止痛

解析：该患者经前小腹疼痛拒按，故诊断为痛经。经期小腹疼痛拒按，有灼热感，经来时加重，为湿热之邪留滞于冲任子宫，气血不畅，经前血海气血充盈，湿热与血互结壅滞不通所致。湿热扰血，故经色暗红，质黏；湿热累及任带二脉，故带下黄稠，湿热缠绵，气滞湿阻，故平时少腹时痛，低热，湿热之邪蕴结下焦，故溲黄。舌红，苔黄腻，脉弦数均为湿热蕴结之象，故辨为湿热瘀阻证。理气活血，化瘀止痛为气滞血瘀证的治法（A错）。痛经湿热瘀阻证治宜清热除湿，化瘀止痛（B对）。益气补虚，化瘀止痛为气虚血瘀证的治法（C错）。养血柔肝，理气止痛为肝郁血虚证的治法（D错）。调和营卫，化瘀止痛为营卫不和，血瘀疼痛之证的治法（E错）。